分子中含有甲基亚砜基苯基和茚结构，属于前药，在体内甲基亚砜基苯基需经代谢生成甲硫苯基后才有生物活性的药物是
A. 对乙酰氨基酚
B. 舒林酸
C. 赖诺普利
D. 缬沙坦
E. 氢氯噻嗪

正确答案：B。舒林酸

解析：本题考查舒林酸。分子中含有甲基亚砜基苯基和茚结构，属于前药，在体内甲基亚砜基苯基需经代谢生成甲硫苯基后才有生物活性的药物是舒林酸（B对）。对乙酰氨基酚（A错）在体内代谢过程中，极少部分可由CYP450氧化酶系统转化成毒性代谢产物N-羟基衍生物和N-乙酰亚胺醌。正常情况下代谢产物N-乙酰亚胺醌可与内源性的谷胱甘肽结合而解毒，但在大量或过量服用对乙酰氨基酚后，肝脏内的谷胱甘肽会被耗竭，N-乙酰亚胺醌可进一步与肝蛋白的亲核基团（如SH）结合而引起肝坏死。这也是过量服用对乙酰氨基酚导致肝坏死、低血糖和昏迷的主要原因。赖诺普利（C错）具有两个没被酯化的羧基，且赖诺普利和依那普利是当前唯一使用的两个非前药的ACE抑制剂。缬沙坦（D错）分子中含有酸性的四氮唑基团，用于各类轻、中度高血压，尤其适用于ACE抑制药不耐受的病人；缬沙坦可和氨氯地平组成复方制剂用于治疗原发性高血压，特别是单药治疗不能充分控制血压的患者；缬沙坦可和氢氯噻嗪组成复方制剂用于治疗单一药物不能充分控制血压的轻度至中度原发性高血压，但不适用于高血压的初始治疗。氢氯噻嗪（E错）属于噻嗪类利尿药，它能够抑制肾小管Na⁺-Cl⁻转运体，从而抑制Na⁺-K⁺、Na⁺-H⁺交换而发挥排钠利尿作用。